消化性溃疡患者禁用的药物是
A. 烟酸
B. 洛伐他汀
C. 考来烯胺
D. 氯贝丁酯
E. 硫酸软骨素、硫酸乙酰肝素、硫酸皮肤素复合物

正确答案：A。烟酸

解析：本题考查消化性溃疡患者禁用药。烟酸类（A对）药物具有强烈的胃肠道刺激症状，消化道溃疡患者应禁止服用。洛伐他汀（B错）亲脂性强，胃肠道刺激性较小，不良反应为肝毒性和肌毒性。考来烯胺（C错）适用于高胆固醇血症。氯贝丁酯（D错）属于降血脂药，长期服用诱发胆结石。硫酸软骨素、硫酸乙酰肝素、硫酸皮肤素复合物（E错）即冠心舒，结合在血管内皮表面，能阻止有害因子黏附，从而保护动脉内皮。